疣状癌中含有传统的鳞状细胞癌的病灶时则称为
A. 丛状瘤
B. 棘皮瘤
C. 腺样瘤
D. 畸胎瘤
E. 杂交瘤

正确答案：E。杂交瘤

解析：本题考查口腔黏膜鳞癌及疣状癌。疣状癌中含有传统的鳞状细胞癌的病灶时则称为杂交瘤（E对）。疣状癌中含有传统的鳞状细胞癌的病灶时则称为杂交瘤。